药品所标明的适应证或者功能主治超出规定范围属于
A. 可使用药品
B. 不能使用药品
C. 不合格药品
D. 假药
E. 劣药

正确答案：D。假药

解析：有下列情形之一的为假药：1)药品所含成分与国家药品标准规定的成分不符的；2)以非药品冒充药品或者以他种药品冒充此种药品的。有下列情形之一的药品，按假药论处：1)国务院药品监督管理部门规定禁止使用的；2)依照本法必须批准而未经批准生产、进口，或者依照本法必须检验而未经检验即销售的；3)变质的；4)被污染的；5)使用依照本法必须取得批准文号而未取得批准文号的原料药生产的；6)所标明的适应证或者功能主治超出规定范围的。故根据题干要求，最佳的选项是D。掌握“药品管理及法律责任”知识点。